肺炎伴感染性休克常见于以下肺部炎症，除了
A. 肺炎球菌肺炎
B. 金黄色葡萄球菌肺炎
C. 克雷伯杆菌肺炎
D. 绿脓杆菌肺炎
E. 支原体肺炎

正确答案：E。支原体肺炎

解析：支原体肺炎是自限性疾病，多数病例不经治疗即可自愈，而且支原体感染引起的肺炎多是间质性肺炎，很少侵及肺实质，且不会出现脓毒症或毒血症，故很少伴发感染性休克（E错，为本题正确答案）。肺炎球菌肺炎（A对）的并发症近年已很少见，但是伴有严重脓毒症或者毒血症的患者易发生感染性休克，尤其是老年人。金黄色葡萄球菌肺炎（B对）的毒血症状明显，病情严重者可早期出现周围循环衰竭。克雷伯杆菌肺炎（C对）及绿脓杆菌肺炎（D对）的毒血症状都很明显，均容易发生肺炎伴感染性休克。